与食物同服后，峰浓度降低，达峰时间延迟，故口服制剂应在各前或餐后3小时服用的药物是
A. 沙丁胺醇
B. 沙美特罗
C. 异丙托溴铵
D. 多索茶碱
E. 噻托溴铵

正确答案：A。沙丁胺醇

解析：本题考查短效β₂激动剂。沙丁胺醇（A对）为常用的短效β₂受体激动剂，平喘作用维持4～6h，是缓解轻、中度急性哮喘症状的首选药。